治疗胃癌痰瘀内结证，应首选
A. 生化汤
B. 一贯煎
C. 膈下逐瘀汤
D. 丹参饮
E. 失笑散

正确答案：C。膈下逐瘀汤

解析：膈下逐瘀汤加减（C对）可以祛瘀豁痰，用于治疗胃癌痰瘀内结证。生化汤（A错）用于产后瘀血腹痛。一贯煎（B错）用于肝肾阴虚，肝气不舒证。丹参饮（D错）用于血瘀气滞，心胃诸痛证，但出血性疼痛慎用。失笑散（E错）用于治疗瘀血内停者。